某地开展痛风普查，10万人中发现痛风患者400例，据此可计算的频率指标是
A. 罹患率为400/10万
B. 发病率为400/10万
C. 患病率为400/10万
D. 累计发病率为400/10万
E. 发病密度为400/10万

正确答案：C。患病率为400/10万

解析：本题考查患病率的相关内容。患病率是指某特定时间内总人口中某病新旧病例所占比例。本题10万人中发现痛风患者400例，据此可计算的频率指标是：患病率为400/10万（C对ABDE错）。